下列选项与肺癌无关的是
A. 吸烟
B. 职业致癌因子
C. 电离辐射
D. 饮酒
E. 饮食与营养

正确答案：D。饮酒

解析：饮酒（D错，为本题正确答案）是肝癌的危险因素，与肺癌无关。吸烟（A对）与肺癌发生的关系最为密切，职业致癌因子（B对）、电离辐射（C对）、饮食与营养（E对）、遗传易感性、基因变异等因素也与肺癌的发生有关。